有人利用疫情资料分析了不同地区的疾病分布情况，此属
A. 描述流行病学
B. 分析流行病学
C. 理论流行病学
D. 实验流行病学

正确答案：A。描述流行病学

解析：本题考查描述流行病学的概述。描述流行病学（A对BCD错）是用来描述人群中疾病或健康状况及暴露因素的分布情况，目的是提出病因假设，为进一步调查研究提供线索，该类研究还可用来确定高危人群，评价公共卫生措施的效果等。本题中根据疫情资料分析不同地区的疾病分布情况属于描述流行病学的范畴。